某男，55岁。患痹证20余年，肢体关节疼痛，屈伸不利，关节肿大、僵硬、变形，筋脉拘急，腰膝酸软，骨蒸潮热，舌红，少苔，脉细数。中医辨证是
A. 行痹
B. 痛痹
C. 尪痹
D. 热痹
E. 着痹

正确答案：C。尪痹

解析：本题考查的是痹症的辨证论治。患痹证20余年，肢体关节疼痛，屈伸不利，关节肿大、僵硬、变形，筋脉拘急，腰膝酸软，骨蒸潮热，舌红，少苔，脉细数。中医辨证是尪痹（C对）。痹证是由于风、寒、湿、热等邪气闭阻经络，影响气血运行，导致肢体筋骨、关节、肌肉等处发生疼痛、重着、酸楚、麻木，或关节屈伸不利、僵硬、肿大、变形等症状的疾病。轻者病在四肢关节肌肉，重者可内舍于脏。西医学的风湿性关节炎、类风湿关节炎、反应性关节炎、肌纤维炎、强直性脊柱炎、痛风、增生性骨关节炎等出现痹证的临床表现时，均可参考此内容辨证论治。（一）行痹（A错）：【症状】肢体关节、肌肉疼痛酸楚，关节屈伸不利，可涉及肢体多个关节，疼痛呈游走性，初起可见恶风、发热等表证。舌苔薄白，脉浮或浮缓。（二）痛痹（B错）：【症状】肢体关节疼痛，痛势较剧，部位固定，遇寒则痛甚，得热则痛缓，关节屈伸不利，局部皮肤或有寒冷感。舌质淡，舌苔薄白，脉弦紧。（三）着痹（E错）：【症状】肢体关节、肌肉酸楚、重着、疼痛，肿胀散漫，关节活动不利，肌肤麻木不仁。舌质淡，舌苔白腻，脉濡缓。（四）尪痹：【症状】痹证日久不愈，肢体、关节疼痛，屈伸不利，关节肿大僵硬、变形，甚则肌肉萎缩，筋脉拘急，肘膝不伸，或以尻代踵，以背代头，伴腰膝酸软、骨蒸潮热、自汗、盗汗。舌红或淡，脉细数。热痹（D错）可见关节肿胀，局部肌肤红肿，灼热疼痛。